治疗行痹，在取主穴的基础上，应加
A. 膈俞、血海
B. 肾俞、关元
C. 阴陵泉、足三里
D. 大椎、曲池
E. 合谷、内关

正确答案：A。膈俞、血海

解析：本题考查常见的病症的辩证、处方。痹证行痹为风邪偏盛，取膈俞、血海以活血，遵“治风先治血，血行风自灭”之义（A对）。肾俞、关元功能补肾温阳，无活血之功（B错）。阴陵泉、足三里功能健脾除湿，可用于治疗着痹（C错）。大椎、曲池功能泻热疏风，可用于治疗热痹（Ｄ错）。合谷、内关多用于止痛（E错）。